患儿，男，10岁，患麻疹后3天，低热乏力，颌下淋巴结肿大，牙龈疼痛、出血、口腔奇臭，不敢刷牙，检查可见下前牙唇侧牙龈出血，龈缘溃疡。通常该病的病因是
A. 真菌感染
B. 病毒感染
C. 抵抗力低下+细菌感染
D. HSV-Ⅱ感染
E. 确切病因不清，多种因素

正确答案：C。抵抗力低下+细菌感染

解析：本题考查急性坏死性龈炎的病因。患儿男，10岁，患麻疹（急性传染病）后3天，低热乏力（重度全身症状），颌下淋巴结肿大，牙龈疼痛、出血、口腔奇臭（组织坏死），不敢刷牙，检查可见下前牙唇侧牙龈出血，龈缘溃疡。上述症状，拟诊为急性坏死性龈炎，通常该病的病因为抵抗力低下+细菌感染（C对）。确切病因不清，多种因素（E错）不符合该病特征。真菌感染（A错）可引起原发或继发感染，常与白色念珠菌病有关，主要表现为颊黏膜、腭部、舌头表面或者口咽部表面的白色斑片。病毒感染（B错）可引起以沿单侧周围神经分布的簇集性小水疱为特征，常伴有明显的神经痛的带状疱疹。HSV-Ⅱ感染（D错）仅见于成人，主要引起生殖器疱疹及生殖器炎症。